大众药即
A. FDA
B. WHO
C. USP
D. 0TC
E. UPS

正确答案：D。0TC

解析：本题考查非处方药。大众药即OTC（D对）。非处方药为柜台药或大众药，是指由国家药品监督管理局公布的，不需要凭执业医师和执业助理医师处方，消费者可以自行判断、购买和使用的药品。非处方药是经过临床较长时间验证、疗效肯定、服用方便、被实践证明消费者可以在药师指导下自主选择的药品，但必须按非处方药标签和说明书所示内容合理使用。非处方药专有标识是用于已列入《国家非处方药目录》，并通过药品监督管理部门审核登记的非处方药药品标签、使用说明书、内包装、外包装的专有标识，也可用作经营非处方药药品的企业指南性标志。我国非处方药专有标识图案为椭圆形背景下的OTC3个英文字母的组合，这也是国际上对非处方药的习惯称谓。FDA（A错）为美国食品与药品管理局的缩写。WHO（B错）是世界卫生组织的缩写。USP（C错）为《美国药典》的缩写。